男，34岁，左上第三磨牙阻生颊侧移位，要求拔除。行上齿槽后神经阻滞麻醉后左面颊部立即肿胀。可能发生的术中并发症不包括
A. 出血
B. 断根
C. 牙槽骨骨折
D. 邻牙损伤
E. 干槽症

正确答案：E。干槽症

解析：本题考查牙拔除术中并发症。干槽症属于术后并发症（E错，为本题的正确答案）。牙拔除术中并发症：1.晕厥。2.牙根折断、牙及断根移位。3.软组织损伤。4.骨组织损伤。5.邻牙、对颌牙损伤。6.神经损伤。7.颞下颌关节损伤。8.术中出血。9.口腔上颌窦交通。10.其他并发症：（1）牙及异物的误吞、误吸；（2）器械折断。综上所述，出血（A对）、断根（B对）、牙槽骨骨折（C对）、邻牙损伤（D对）属于拔牙术中并发症。